分离布鲁菌（布氏杆菌）阳性率最高的患者标本是
A. 血液
B. 粪便
C. 尿液
D. 痰
E. 骨髓

正确答案：A。血液